甲氨蝶呤中毒时可使用亚叶酸进行解救，其目的是提供
A. 二氢叶酸
B. 叶酸
C. 四氢叶酸
D. 谷氨酸
E. 蝶呤酸

正确答案：C。四氢叶酸

解析：本题考查叶酸拮抗剂类抗肿瘤药。甲氨蝶呤中毒时可使用亚叶酸进行解救，其目的是提供四氢叶酸（C对）。甲氨蝶呤是二氢叶酸还原酶的抑制剂，使二氢叶酸（A错）不能转化为四氢叶酸，从而影响辅酶F的生成，干扰胸腺嘧啶脱氧核苷酸和嘌呤核苷酸的合成，因而对DNA和RNA的合成均可抑制。甲氨蝶呤剂量过大引起中毒时，可用亚叶酸钙解救。亚叶酸钙是四氢叶酸钙甲酰衍生物的钙盐，在体内可转变为四氢叶酸，能有效地对抗甲氨蝶呤引起的毒性反应。谷氨酸（D错）和蝶呤酸（E错）是甲氨蝶呤的水解产物。氨甲喋呤对叶酸（B错）没有影响。